可以治疗军团菌、支原体、衣原体的药物是
A. 人工合成类
B. 氨基苷类抗生素
C. 四环素类
D. 大环内酯类
E. 头孢类

正确答案：D。大环内酯类